对合并有高氨血症的便秘患者，适宜使用的泻药是
A. 甘油
B. 聚乙二醇4000
C. 乳果糖
D. 硫酸镁
E. 酚酞

正确答案：C。乳果糖

解析：本题考查乳果糖。乳果糖（C对）是一种渗透性泻药，用于治疗慢性功能性便秘，治疗高血氨症及由血氨升高引起的疾病。甘油（A错）为润滑性泻药，用于年老体弱者便秘的治疗。聚乙二醇4000（B错）为治便秘药，用于缓解成人便秘的症状。硫酸镁（D错）为抗惊厥药。酚酞（E错）为泻药，用于习惯性顽固性便秘。